健康危险因素评价对下列哪种疾病的预防是相对有效的措施
A. 痢疾
B. 心脑血管疾病
C. 流行性感冒
D. 乙型脑炎
E. 麻疹

正确答案：B。心脑血管疾病